代偿性DIC主要表现为：
A. 凝血物质生成超过消耗
B. 凝血物质消耗超过生成
C. 凝血物质生成与消耗相平衡
D. 凝血与纤溶程度相平衡
E. 凝血系统与激肽系统功能相平衡

正确答案：C。凝血物质生成与消耗相平衡

解析：凝血物质生成与消耗相平衡（C对）是代偿性DIC主要表现。实验室检查常无明显异常。临床表现不明显或仅有轻 度出血或血栓形成症状，可转为失代偿型。常见于轻度 DIC。凝血物质生成超过消耗（A错）是过度代偿型DIC主要表现。凝血物质消耗超过生成（B错）是失代偿型DIC主要表现。